属于Ⅰ型超敏反应的疾病是
A. 血清病
B. 过敏性休克
C. 免疫复合物性肾小球肾炎
D. 类风湿关节炎
E. 感染性迟发型超敏反应

正确答案：B。过敏性休克